女，2.5岁。高烧3天，口腔溃疡病2天。啼哭，流涎，拒食。体检发现患儿全口牙龈红肿，上腭黏膜可见密集的针头大小透明水疱，部分已破溃为浅表溃疡，周围黏膜充血水肿广泛。本病例最可能的诊断为疱疹性龈口炎，不适宜本病例治疗的措施是
A. 注意休息加强营养
B. 全身应用抗病毒药物
C. 局部用皮质激素雾化吸入
D. 补充大量维生素
E. 中医中药

正确答案：C。局部用皮质激素雾化吸入

解析：本题考查疱疹性龈口炎的治疗。局部用皮质激素雾化吸入（B错，为本题的正确答案）禁止用于疱疹性龈口炎，以防加重病情。疱疹性龈口炎是由Ⅰ型单纯疱疹病毒引起的口腔病损，其治疗方法包括：全身抗病毒治疗（B对）、局部治疗、对症和支持治疗、中医中药治疗（E对）。注意休息加强营养（A对）和补充大量维生素（D对）属于支持治疗的方法。